下列有关流行性出血热的描述，正确的是
A. 发病以青少年为主
B. 一般不经呼吸道传播
C. 无明显季节性
D. 所有患者均有五期经过
E. 可有母婴传播

正确答案：E。可有母婴传播

解析：流行性出血热即肾病综合征出血热，传播途径有：呼吸道传播（B错）、消化道传播、接触传播、母婴垂直传播（E对）、虫媒传播。流行性出血热具有人普遍易感性（A错），且具有地区性、季节性（C错）及周期性的特点。典型病例可有发热期、低血压休克期、少尿期、多尿期和恢复期五期经过，但轻型病例可出现越期现象（D错）。